人体内合成尿素的主要脏器是
A. 脑
B. 肌组织
C. 肾
D. 肝
E. 心

正确答案：D。肝